明目上清片除清热散风外，又能
A. 明目止痛
B. 活血通络
C. 明目滋阴
D. 养肝明目
E. 行气止痛

正确答案：A。明目止痛

解析：本题考查的是明目上清片的功能。明目上清片除清热散风外，又能明目止痛（A对）。明目上清片：【功能】清热散风，明目止痛。消栓胶囊：【功能】补气活血通络（B错）。石斛夜光颗粒：【功能】滋阴补肾，清肝明目（C错）。明目地黄丸：【功能】滋肾，养肝，明目（D错）。血府逐瘀口服液：【功能】活血祛瘀，行气止痛（E错）。